鉴别中心型肺癌和周围型肺癌最有价值的检查是
A. 血肿瘤标志物
B. 胸部正侧位X线片
C. 胸部CT
D. 胸部核磁共振
E. 痰细胞学

正确答案：C。胸部CT

解析：胸部CT（C对）图像避免了病变与正常组织互相重叠，可发现一般X线检查隐蔽区的病变，因其薄层扫描，密度分辨率很高，可以显示直径更小、密度更低的病变，对于中心型肺癌和周围型肺癌诊断最有价值。血肿瘤标志物（A错）、痰细胞学（E错）只能辅助诊断肺癌，不能鉴别肿瘤的位置，故不选。胸部正侧位X线片（B错）一般仅用于肺癌的筛查，诊断价值不及胸部CT。胸部核磁共振（D错）并非肺癌诊断的常用方法，一般用于诊断肺上沟瘤。